一般不放在统计表中的项目为
A. 线条
B. 横标目
C. 纵标目
D. 数字
E. 备注

正确答案：E。备注